某女，38岁。患慢性盆腔炎与慢性宫颈炎，症见带下量多，色黄质稠臭秽，小腹胀痛，腰骶酸痛，神疲乏力。证属湿热瘀阻所致带下病，腹痛，医师处以妇科千金片，药师在售药时，向其详述该成药的用法与注意事项。其中注意事项有
A. 寒凝血瘀者慎用
B. 糖尿病患者慎用
C. 饮食宜清淡，忌辛辣食物
D. 气滞血瘀者慎用
E. 孕妇慎用

正确答案：A、B、C、D、E。寒凝血瘀者慎用；糖尿病患者慎用；饮食宜清淡，忌辛辣食物；气滞血瘀者慎用；孕妇慎用

解析：本题考查的是妇科千金片的注意事项。妇科千金片的注意事项有寒凝血瘀证者慎用（A对）、糖尿病患者慎用（B对）、饮食宜清淡，忌辛辣食物（C对）、气滞血瘀者慎用（D对）与孕妇慎用（E对）。妇科千金片：【注意事项】气滞血瘀、寒凝血瘀者慎用。孕妇慎用。饮食宜清淡，忌食辛辣食物。糖尿病患者慎用。